与相应的激素失调有关的肿瘤包括
A. 乳腺癌
B. 睾丸肿瘤
C. 前列腺癌
D. 宫颈癌
E. 以上均包括

正确答案：E。以上均包括

解析：某些肿瘤如乳腺癌、前列腺癌、甲状腺癌、宫颈癌、卵巢癌和睾丸肿瘤与相应的激素失调有关。掌握“抗恶性肿瘤药”知识点。